儿童上乳前牙外伤常见年龄为
A. 1～2岁
B. 3～4岁
C. 4～5岁
D. 6～7岁
E. 8～9岁

正确答案：A。1～2岁

解析：乳牙外伤多发生在1～2岁儿童；年轻恒牙外伤多发生于7～9岁儿童；年轻恒牙外伤发生率高于乳牙；男孩发生率高于女孩。本题考查牙外伤概述及乳牙外伤。